男，30岁。因消化性溃疡行胃大部切除，毕Ⅱ式吻合术治疗。术后第5天，突发右上腹剧痛。查体：心肺未见明显异常，手术切口无明显渗出，全腹肌紧张、压痛（+），以右上腹为著。最可能的诊断是
A. 十二指肠残端破裂
B. 输入段肠袢梗阻
C. 急性胰腺炎
D. 急性胆囊炎并穿孔
E. 胃肠吻合口出血

正确答案：A。十二指肠残端破裂

解析：患者溃疡行胃大部切除，毕Ⅱ式吻合术，术后第5天，突发右上腹剧痛，全腹肌紧张、压痛，以右上腹为著（腹膜刺激体征）。最可能的诊断是十二指肠残端破裂（A对）。输入段肠袢梗阻（B错）为上腹部剧烈腹痛伴呕吐。呕吐物不含胆汁。上腹部常可扪及肿块。